白带呈脓性泡沫状，用酸性液体冲洗阴道可提高疗效
A. 滴虫阴道炎
B. 外阴阴道假丝酵母菌病
C. 萎缩性阴道炎
D. 婴幼儿外阴阴道炎
E. 淋球菌阴道炎

正确答案：A。滴虫阴道炎

解析：白带呈脓性泡沫状是滴虫性阴道炎（A对）分泌物的典型特点，阴道毛滴虫在pH5以下环境中不能生长，用酸性液体冲洗阴道可提高其疗效。外阴阴道假丝酵母菌病（P249）（B错）的分泌物由脱落上皮细胞和菌丝体、酵母菌和假菌丝组成，其特征为白色稠厚呈凝乳或豆腐渣样；有假丝酵母菌感染的阴道pH多在4.0～4.7，通常﹤4.5，酸性环境适宜假丝酵母菌生长。萎缩性阴道炎（P252）（C错）的阴道分泌物稀薄，淡黄色，感染严重者呈脓血性白带；治疗时补充雌激素来增加增加阴道抵抗力，使用抗生素来抑制细菌。婴幼儿外阴阴道炎（P253）（D错）主要症状为阴道分泌物增多，呈脓性；治疗时针对病原体选择相应抗生素口服，或用吸管将抗生素溶液滴入阴道。淋球菌阴道炎（E错）主要表现为阴道脓性分泌物增多；治疗原则为及时、足量、规范使用抗生素，以第三代头孢菌素为主。